排尿反射的感受器是
A. 膀胱壁的牵张感受器
B. 尿道的感受器
C. 盆神经
D. 脊髓
E. 骶髓

正确答案：A。膀胱壁的牵张感受器